有关颌骨骨结核叙述错误的是
A. 多为血行播散所致
B. 一般为无症状的渐进性发展
C. 病变部位的软组织呈弥漫性肿胀
D. 肿胀区表面皮肤和黏膜常为化脓性感染的充血
E. 偶有自发痛和全身低热

正确答案：D。肿胀区表面皮肤和黏膜常为化脓性感染的充血

解析：感染途径可因体内其他脏器结核病沿血行播散所致；骨结核一般为无症状的渐进性发展，偶有自发痛和全身低热。病变部位的软组织呈弥漫性肿胀，其下可扪及质地坚硬的骨性隆起，有压痛，肿胀区表面皮肤和黏膜常表现为无化脓性感染的充血发红。掌握“颌面部骨结核、放线菌病”知识点。